行颈胸手术后，病人应采取的体位是
A. 平卧位
B. 侧卧位
C. 高坡卧位
D. 低半坐位
E. 15°～30°头高脚低斜坡卧位

正确答案：C。高坡卧位

解析：一般来说颈、胸部手术采用高半坐位卧式（高坡卧位），以便于呼吸及有效引流（C对）；平卧位（A错）见于全麻未清醒、蛛网膜下腔麻醉后；侧卧位（B错）多见于肥胖病人，有利于呼吸和静脉回流；低半卧位（D错）或15°～30°头高脚低斜坡卧位（E错）多用于腹部手术后，可减少腹壁张力。